患者咳逆喘满不得卧，气短气急，咳痰白稀，呈泡沫状，胸部膨满，口干不欲饮，周身酸楚，恶寒，面色青暗，舌体暗淡，苔白滑，脉浮紧。治应选用
A. 小青龙汤
B. 越婢加半夏汤
C. 麻黄汤
D. 麻杏石甘汤
E. 定喘汤

正确答案：A。小青龙汤

解析：本题肺胀患者由于痰饮阻遏，肺气壅滞，肺失宣降，肺气上逆，则胸部膨满，咳逆喘满不得卧，气短气急，咳痰白稀，呈泡沫状；寒饮阻遏气机，津液不布口舌，故口干不欲饮；寒饮郁遏，阳郁不伸，血行瘀滞，则面色青暗，舌体暗淡；外有寒邪束表，故恶寒，周身酸楚；脉浮紧说明内有饮邪，外有束寒；故应温肺散寒，涤痰降逆，用小青龙汤（A对）加减。越婢加半夏汤（B错）用于痰热郁肺证，以清肺化痰，降逆平喘。麻黄汤（C错）用于喘证之风寒闭表，以宣肺散寒。麻杏石甘汤（D错）用于喘证之表寒里热证，以散寒泄热，宣肺平喘。定喘汤（E错）用于风寒外束，痰热内蕴证，以宣降肺气，清热化痰。